男，8个月。持续高热频咳，精神萎靡5天，近2天气促加重，今抽搐3次全身性发作嗜睡。查体：体温40℃，呼吸54次/分，心率148次/分，双肺少量湿啰音，左下肺闻及管状呼吸音，肝肋下lcm，白细胞计数明显升高。X线显示大小不等的片状病灶或融合性病灶，以两肺下野及右上肺多见。病程中，患儿出现弛张高热，胸部X线片出现新的阴影。提示
A. 原有感染加重
B. 合并细菌感染
C. 病情好转前征兆
D. 并发败血症
E. 并发心衰

正确答案：B。合并细菌感染

解析：腺病毒易继发细菌感染（B对），表现为：持续高热不退、症状恶化或一度好转又恶化、痰液由白色转为黄色脓样；外周白细胞明显升高，有核左移；胸部X线见病变增多或发现新的病灶。